急性中度有机磷农药中毒患者全血胆碱酯酶活性一般为
A. ≥80％
B. 70～80％
C. 50～70％
D. 30～50％
E. ＜30％

正确答案：D。30～50％